腭前神经阻滞麻醉时出现恶心或呕吐，可能是由于
A. 注射点过低
B. 针尖刺入过深
C. 针尖刺入过前
D. 针尖刺入过后
E. 麻药注射入血管内

正确答案：D。针尖刺入过后

解析：本题考查局部麻醉并发症及防治。腭前神经阻滞麻醉区域及效果：同侧磨牙、双尖牙腭侧的粘骨膜，牙龈及牙槽骨。注意行腭大孔注射时，注射麻药不可过多，注射点不可偏后（D对），以免同时麻醉腭中、腭后神经，引起软腭、悬雍垂麻痹而致恶心或呕吐。